患者神情默然，如寒无寒，如热无热，时欲饮食，时见纳呆，坐卧不安，口苦，小便赤，脉微数，治宜
A. 甘麦大枣汤
B. 百合鸡子汤
C. 百合知母汤
D. 百合地黄汤
E. 甘草泻心汤

正确答案：D。百合地黄汤

解析：百合病的临床表现，首先是心肺阴虚内热引起心神不安及饮食行为失调等症状，如意欲饮食复不能食、欲卧不能卧、欲行不能行、如寒无寒、如热无热等。百合病的病机，主要是阴虚内热。治当补其阴之不足，以调整阳之偏胜，即所谓“见于阳者，以阴法救之”。故用百合地黄汤养心润肺，益阴清热（D对）。方中百合甘寒，清气分之热；地黄汁甘润，泻血分之热。如同陈灵石所说：“皆取阴柔之品，以化阳刚，为泄热救阴法也。”泉水下热气，利小便，用以煎百合，增强其清热之效。